某女，42岁，素体壮健，突患中毒性脑病，症见高热，惊厥，神昏，谵语，医师对其施用西医常规治疗外，又处以安宫牛黄丸，以增加疗效，药师亲自将安宫牛黄丸送至床头，并详告家属该成药的用法与注意事项。其中，安宫牛黄丸的注意事项有
A. 孕妇禁用
B. 不宜过量或久服
C. 寒闭神昏者不宜使用
D. 肝肾功能不全者慎用
E. 服药期间忌食辛辣食物

正确答案：B、C、D、E。不宜过量或久服；寒闭神昏者不宜使用；肝肾功能不全者慎用；服药期间忌食辛辣食物

解析：本题考查的是安宫牛黄丸的注意事项。安宫牛黄丸的注意事项有孕妇禁用（A对）、不宜过量或久服（B对）、寒闭神昏者不宜使用（C对）、肝肾功能不全者慎用（D对）与服药期间忌食辛辣食物（E对）。安宫牛黄丸：【注意事项】孕妇禁用。寒闭神昏者不宜使用。因其含有毒的朱砂、雄黄，故不宜过量服用或久服，肝肾功能不全者慎用。服药期间，忌食辛辣食物。在治疗过程中如出现肢寒畏冷、面色苍白、冷汗不止、脉微欲绝，由闭证变为脱证者应立即停药。高热神昏、中风昏迷等口服本品困难者，当鼻饲给药。